牙痛龈肿，口气热臭，舌红苔黄，脉滑数者。治宜选用
A. 玉女煎
B. 芍药汤
C. 龙胆泻肝汤
D. 清胃散
E. 凉膈散

正确答案：D。清胃散

解析：题干所述患者牙痛龈肿，口气热臭，乃胃有积热，循经上攻所致。舌红苔黄，脉滑数，俱为胃热津伤之候，治宜清胃凉血。清胃散方用黄连为君，直折胃腑之热，臣以升麻，一取其清热解毒，以治胃火牙痛；一取其轻清升散透发，可宣达郁遏之伏火；以生地凉血滋阴；丹皮凉血清热，当归养血活血，合生地滋阴养血，合丹皮消肿止痛；升麻兼以引经为使，诸药合用，共奏清胃凉血之效（D对）；玉女煎主治少阴不足，阳明有余之证，此患者无少阴不足之表现（A错）；芍药汤治疗由湿热壅滞肠中，气血失调所致的湿热痢疾，不能治疗胃火牙痛（B错）；龙胆泻肝汤能清肝胆实火，清利肝经湿热，不能够清胃火（C错）；凉膈散治疗证由脏腑积热，聚于胸膈所致的上中二焦的火热证，以清胸膈之热为主，清胃之力较差（E错）。